从情感范畴来看，爱国心是一种
A. 责任感
B. 情操
C. 集体感
D. 道德感
E. 荣誉感

正确答案：D。道德感

解析：人类高级的社会性情感主要有道德感、理智感和美感。道德感是在评价人的思想、意图和行为是否符合道德标准时产生的情感。不同历史时代、社会制度、民族有不同的道德标准，所以道德感具有社会历史性。爱国心是个人或集体愿意对祖国的一种积极和支持的态度，用来评价一人对国家的热爱以及为国家利益所付出的感情，因此，爱国心是一种道德感（D对）。